香豆类化合物具有荧光的原因是结构中的7位连有
A. 酚羟基
B. 苯环
C. 烷基
D. 甲氧基
E. 羧基

正确答案：A。酚羟基

解析：本题考查的是香豆素的荧光性质。香豆类化合物具有荧光的原因是结构中的7位连有酚羟基（A对）。香豆素的荧光性质：香豆素类在可见光下为无色或浅黄色结晶。香豆素母体本身无荧光，而羟基香豆素在紫外光下多显出蓝色荧光，在碱溶液中荧光更加显著。香豆素类荧光与分子中取代基的种类和位置有一定关系：一般在C-7位引入羟基即有强烈的蓝色荧光，加碱后可变为绿色荧光；但在C-8位再引入一羟基，则荧光减至极弱，甚至不显荧光。呋喃香豆素多显蓝色荧光，荧光性质常用于色谱法检识香豆素。